以下肾上腺素能系统结合相应递质后产生的生理作用不正确的是
A. 瞳孔缩小
B. 心率加快
C. 心肌收缩力增强
D. 支气管平滑肌舒张
E. 冠状血管收缩

正确答案：A。瞳孔缩小